下列选项中，不属于阴阳互根关系的是
A. 阴在内，阳之守也
B. 孤阴不生，独阳不长
C. 阳在外，阴之使也
D. 重阴必阳，重阳必阴
E. 阴损及阳，阳损及阴

正确答案：D。重阴必阳，重阳必阴

解析：阴阳互根，指阴阳的互为根本、相互依存的关系，即“阳根于阴，阴根于阳”。阳的根本在阴，阴的根本在阳，双方互为存在的前提。互为根本的阴阳双方具有相互资生、促进和助长的作用。阴阳互根的意义，在于阴阳始终处于统一体之中，每一方都以对方的存在作为自身存在的前提和条件，任何一方都不能脱离对方而单独存在（D错，为本题正确答案）。